在一项750名病例和750名对照的冠心病危险因素研究中，分别在500名病例和150名对照中发现可疑病因因素，具有该因素者的冠心病发生率是
A. 0.667
B. 0.367
C. 0.2
D. 0.1
E. 以上资料不能计算

正确答案：E。以上资料不能计算

解析：本题考查病例对照研究的分析指标。在病例对照研究中，没有暴露组和非暴露组的观察人数，因此不能计算发病率（E对ABCD错）。